脂瘤独有的特征是
A. 数目不等，大小不一，肿形如馒，推之可移
B. 青筋垒垒，盘曲成团，质地柔软，表面青蓝
C. 瘤中心有粗大毛囊孔，可挤出臭味脂浆
D. 瘤体单发，质地硬韧，界限清楚，推之可移
E. 瘤体深隐，质地坚硬，境界清楚，推之不移

正确答案：C。瘤中心有粗大毛囊孔，可挤出臭味脂浆

解析：数目不等，大小不一，肿形如馒，推之可移为肉瘤的特征（A错）。青筋垒垒，盘曲成团，质地柔软，表面青蓝为筋瘤的特征（B错）。脂瘤多因痰凝气结而生，常发于头面、项背、臀部等处，小的似豆，大的如鸡蛋，生长缓慢，软而不硬，皮色淡红，推之可移动，瘤顶端中心有粗大毛囊孔，可挤压出有臭味的豆腐渣状物质（C对）。脂瘤质地软而不硬（DE错）。